以下哪种不是单克隆抗体的特点
A. 识别一种抗原表位
B. 来源广泛，制备容易
C. 纯度高
D. 效价高
E. 特异性

正确答案：B。来源广泛，制备容易

解析：单克隆抗体的优点：结构均一、纯度高、特异性强、效价高、少或无血清交叉反应、制备成本低。掌握“各类球蛋白的特性和功能”知识点。